风温，症见潮热便秘，胸腹胀满，喘促不宁，痰涎壅盛，苔黄腻或黄滑，脉右寸实大选用下列哪-处方最适宜
A. 宣白承气汤
B. 小陷胸加枳实汤
C. 桑菊饮加石膏知母大黄
D. 凉膈散加杏仁瓜蒌
E. 增液承气汤

正确答案：A。宣白承气汤

解析：根据题意可知，此病为风温，根据潮热便秘，胸腹胀满，喘促不宁，痰涎壅盛，苔黄腻或黄滑，脉右寸实大，可辨为肺热腑实。其机理为既有肺经痰热壅阻，又有肠腑热结不通之肺肠同病。痰热阻肺，肃降无权，则出现喘促不宁，右脉实大，舌苔也多见黄腻或黄滑；阳明腑实热结，腑气不通则潮热、便秘。由于肺与大肠相表里，肺气不降则腑气亦不易下行；肠腑中热结不通，则肺中之邪亦少外泄之机，故治宜宣肺化痰，泄热攻下，方选宣白承气汤（A对）。方中以生石膏清肺胃之热；杏仁、瓜蒌皮宣降肺气，化痰定喘；大黄攻下腑实。